比值算术均数型环境质量指数的缺点是
A. 与参数个数有关
B. 计算复杂
C. 掩盖高浓度分指数的影响
D. 没有考虑指数的权重
E. 缺乏评价标准

正确答案：C。掩盖高浓度分指数的影响

解析：本题考查比值算术均数型环境质量指数的缺点。比值算术均数型大气质量指数是在比值简单叠加的基础上加以平均，其特点是计算简便，消除了选用参数个数的影响，但由于它是各分指数的平均值，故当只有某个分指数很高，其余各分指数不高时，最后得出的综合质量指数值可能偏低而掩盖了高浓度那个参数的影响（C对ABDE错）。